能解热镇痛的成药是
A. 感冒灵颗粒
B. 银柴颗粒
C. 加味银翘片
D. 羚翘解毒片
E. 桑菊感冒片

正确答案：A。感冒灵颗粒